患者，女性，40岁。有风湿性关节炎病史10年，近5年出现呼吸困难、咳嗽和咯血等症状，并有肝大、腹水、双下肢水肿。查体：心尖区可闻及隆隆样舒张期杂音。心电图示右室大。为明确诊断不必要的辅助检查是
A. 血沉
B. 胸部X线检查
C. 超声心动图
D. 风湿系列检查
E. 冠状动脉造影

正确答案：E。冠状动脉造影

解析：该患者有风湿性关节炎病史10年，近5年出现呼吸困难、咳嗽和咯血等症状（左心衰表现），并有肝大、腹水、双下肢水肿（右心衰表现）。 查体:心尖区可闻及隆隆样舒张期杂音（二尖瓣狭窄特征性杂音），心电图示右室大。综合该患者临床表现和二尖瓣狭窄特征性杂音可诊断为二尖瓣狭窄。血沉（A对）、风湿系列（D对）可用来检查该患者的风湿热是否处于活动期。胸部X线检查（B对）心脏的形态，评估心脏大小和肺动脉变化。超声心动图（C对）是确诊二尖瓣狭窄最敏感可靠的方法。冠状动脉造影（E错，为本题正确答案）常用于冠心病的确诊，用于评估冠状动脉的狭窄程度。